药材具有羊膻气的是
A. 北沙参
B. 瓜蒌
C. 海马
D. 滑石
E. 白鲜皮

正确答案：E。白鲜皮

解析：本题考查的是白鲜皮药材的性状鉴别。药材具有羊膻气的是白鲜皮（E对）。白鲜皮：【性状鉴别】药材呈卷筒状。外表面灰白色或淡灰黄色，具细纵皱纹及细根痕，常有突起的颗粒状小点；内表面类白色，有细纵纹。质脆，折断时有粉尘飞扬，断面不平坦，略呈层片状，剥去外层，迎光可见有闪烁的小亮点。有羊膻气，味微苦。北沙参（A错）：【性状鉴别】药材呈细长圆柱形，偶有分枝。表面淡黄白色，略粗糙，偶有残存外皮。不去外皮的表面黄棕色，全体有细纵皱纹及纵沟，并有棕黄色点状细根痕；顶端常留有黄棕色根茎残基；上端稍细，中部略粗，下部渐细。质脆，易折断，断面皮部浅黄白色，木部黄色。气特异，味微甘。瓜蒌（B错）：【性状鉴别】药材呈类球形或宽椭圆形。表面橙红色或橙黄色，皱缩或较光滑，顶端有圆形的花柱残基，基部略尖，具残存的果梗。轻重不一。质脆，易破开，内表面黄白色，有红黄色丝络，果瓤橙黄色，黏稠，与多数种子黏结成团。具焦糖气，味微酸、甜。海马（C错）：【性状鉴别】药材线纹海马呈扁长形而弯曲。表面黄白色。头略似马头，有冠状突起，具管状长吻，口小，无牙，两眼深陷。躯干部七棱形；尾部四棱形，渐细卷曲，体上有瓦楞形的节纹并具短棘。体轻，骨质，坚硬。气微腥，味微咸。滑石（D错）：【性状鉴别】药材多为块状集合体。呈不规则块状。白色、黄白色或淡蓝灰色，有蜡样光泽。质软，细腻，手摸有滑润感，无吸湿性，置水中不崩散。气微，味淡。